参与构成颞下颌关节的是
A. 喙突
B. 乳突
C. 髁突
D. 关节结节
E. 齿突

正确答案：D。关节结节

解析：下颌骨下颌头和颞骨的下颌窝和关节结节（D对）共同组成颞下颌关节。